某男，20岁。夏初内气温突降，小雨不断，患流行性感冒2天。症见发热，恶寒肌肉酸痛，鼻塞流涕，咳嗽，头痛，咽干咽痛，舌偏红，苔黄腻。证属热毒袭肺，宜选用的成药是
A. 荆防颗粒
B. 桂枝合剂
C. 双黄连颗粒
D. 九味羌活颗粒
E. 连花清瘟胶囊

正确答案：E。连花清瘟胶囊

解析：本题考查的是连花清瘟胶囊的主治。夏初内气温突降，小雨不断，患流行性感冒2天。症见发热，恶寒肌肉酸痛，鼻塞流涕，咳嗽，头痛，咽干咽痛，舌偏红，苔黄腻。证属热毒袭肺，宜选用的成药是连花清瘟胶囊（E对）。连花清瘟胶囊：【主治】流行性感冒属热毒袭肺证，症见发热、恶寒、肌肉酸痛、鼻塞流涕、咳嗽、头痛、咽干咽痛、舌偏红、苔黄或黄腻。荆防颗粒（A错）：【主治】外感风寒挟湿所致的感冒，症见头身疼痛、恶寒无汗、鼻塞流涕、咳嗽。桂枝合剂（B错）：【主治】感冒风寒表虚证，症见头痛发热、汗出恶风、鼻塞干呕。双黄连颗粒（C错）：【主治】外感风热所致的感冒，症见发热、咳嗽、咽痛。九味羌活颗粒（D错）：【主治】外感风寒夹湿所致的感冒，症见恶寒、发热、无汗、头重而痛、肢体酸痛。